参与成肋弓的肋软骨
A. 第6-10
B. 第7-10
C. 第8-10
D. 第9-10
E. 第8-12

正确答案：C。第8-10

解析：第8-10肋是参与成肋弓的肋软骨（B对）。第 11 -12 对肋前端游离于腹壁肌层中，称浮肋（E错）。